患者，男，50岁。便后出血，有时粪中带血，血色鲜红，舌红，脉数。治疗应首选
A. 槐花散
B. 黄土汤
C. 归脾汤
D. 四生丸
E. 小蓟饮子

正确答案：A。槐花散

解析：患者便后出血，有时粪中带血，血色鲜红，舌红，脉数。方用槐花散，为治疗肠风、脏毒下血的常用方。槐花清大肠湿热，凉血止血；侧柏叶清热止血；荆芥穗疏风，炒用入血分而止血；枳壳行气宽肠（A对）。黄土汤为治疗脾阳不足所致的便血或崩漏的常用方（B错）。归脾汤方证因思虑过度，劳伤心脾，气血亏虚所致。为治疗心脾气血两虚的常用方（C错）。四生丸治疗血热妄行所致的上部出血证（D错）。小蓟饮子为治疗血淋、尿血属实热证的常用方（E错）。趣记：槐花散百岁之——槐花散柏穗枳。